一项调查收集了当地哮喘疾病频率资料，并从有关部门获取了该年度空气质量监测数据，欲作哮喘患病与空气质量关系研究，应采用的研究设计方法是
A. 普查
B. 抽样调查
C. 现况研究
D. 生态学研究
E. 病例报告

正确答案：D。生态学研究

解析：本题考查生态学研究。生态学研究（D对ABCE错）是在群体的水平上研究某种暴露因素与疾病之间的关系，以群体为观察和分析的单位，通过描述当地人群中空气质量与哮喘患病之间的关系，分析空气质量与哮喘之间的关系。